女性，60岁。左上后牙．剧烈自发痛2天。有放散痛。叩诊（+），探诊深龋洞，有穿髓孔，探痛（+++）。无松动，牙周检查（-）。最佳急诊处理方法是
A. 安抚治疗
B. 服用消炎止痛药
C. 开髓引流
D. 针刺镇痛
E. 切开排脓

正确答案：C。开髓引流

解析：本题考查应急处理-开髓引流。女性，60岁。左上后牙．剧烈自发痛2天。有放散痛。叩诊（+），探诊深龋洞，有穿髓孔，探痛（+++）。无松动，牙周检查（-）。最佳急诊处理方法是开髓引流（C对）。该患者左上后牙有剧烈自发痛、放射痛，可查及穿髓的深龋洞，探诊剧烈疼痛，因患牙处于晚期炎症，牙髓炎症的外围区已波及根尖部的牙周膜，故出现叩诊（+），牙周检查（-），牙无松动，排除根尖周病变的可能性，患者的临床表现符合急性牙髓炎的病变特点。急性牙髓炎应急处理的目的是引流炎症渗出物和缓解因之而形成的髓腔高压，以减轻剧痛，因而最佳急诊处理应是开髓引流，缓解疼痛。安抚处理（A错）适用于牙髓充血、有轻度炎症的患牙，可缓慢作用于牙髓使其炎症消退或减轻，不能有效缓解剧烈疼痛，因而不是急性牙髓炎的急诊处理。服用消炎止痛药（B错）对牙髓炎有一定的镇痛效果，但并不能立即减缓患牙疼痛。针刺镇痛（D错）仅能缓解轻微的疼痛，不能解决因髓腔高压而产生的牙髓剧烈疼痛。切开排脓（E错）适用于急性根尖周炎发展至骨膜下或黏膜下脓肿期的病例，该患者无根尖周脓肿形成，故无需切开排脓。